额叶中央区（前回）胶质瘤最常见的临床表现是
A. 肢体无力
B. 弱视
C. 象限盲
D. 命名性失语
E. 失认

正确答案：A。肢体无力

解析：额叶中央前回是大脑皮质运动区，该区大锥体细胞的轴突构成了锥体束的大部，支配对侧半身的随意运动，故额叶中央前回胶质瘤会产生肢体无力（A对）症状（P008）。弱视（B错）见于枕叶的病变，象限盲（C错）见于枕叶舌回和楔回损害；命名性失语（D错）见于优势半球颞中回后部损害，失认（E错）见于顶叶病变。